一般情况下固定桥最理想的固位体是
A. 嵌体
B. 高嵌体
C. 部分冠
D. 全冠
E. 桩冠

正确答案：D。全冠

解析：全冠覆盖基牙牙冠的各个面，其固位力最强，且能恢复部分缺损的牙冠形态。也是临床上最常用的固定桥的固位体。掌握“固定桥的设计”知识点。